疼痛但能忍受，能正常生活及睡眠，其程度属
A. 0级
B. 1级
C. 2级
D. 3级
E. 4级

正确答案：B。1级

解析：患者虽有痛感但是仍然可以忍受，能正常生活及睡眠，为主诉分级法中的1级轻度疼痛。（B对）。0级：无痛（A错）。2级：中度疼痛。疼痛不能耐受，需要用止痛剂，睡眠受干扰。靠止痛治疗（C错）。3级：重度疼痛。疼痛剧烈，伴有自主神经功能紊乱，严重干扰睡眠，被动体位，必须依靠止痛药治疗（D错）。4级：极重度疼痛。为不可忍受的疼痛（E错）。